高血压患者余某，体重75kg，收缩压170mmHg，舒张压98mmHg，心电图不正常，ST-T改变，有大量饮酒嗜好。医生通过心电图检查发现该患者患有轻度冠心病属于
A. 筛检措施
B. 保健措施
C. 第一级预防措施
D. 第二级预防措施
E. 第三级预防措施

正确答案：D。第二级预防措施